适用于老年女性骨质疏松症患者的药物有
A. 利塞膦酸钠
B. 依替膦酸二钠
C. 阿法骨化醇
D. 骨化三醇
E. 盐酸雷洛昔芬

正确答案：A、B、C、D、E。利塞膦酸钠；依替膦酸二钠；阿法骨化醇；骨化三醇；盐酸雷洛昔芬

解析：本题考查适用于老年女性骨质疏松的药物。利塞膦酸钠（A对）、依替膦酸二钠（B对）、阿法骨化醇（C对）、骨化三醇（D对）和盐酸雷洛昔芬（E对）适用于老年女性骨质疏松患者。从机制出发，骨质疏松药可分为抑制骨吸收药和促进骨形成药两类，利塞膦酸钠能够与骨中羟磷灰石结合，具有抑制骨吸收的作用。依替膦酸二钠对体内磷酸钙有较强的亲和力，能抑制人体异常钙化和过量骨吸收，减轻骨痛。阿法骨化醇在体内起调节钙、磷的平衡作用。骨化三醇能增加肠道钙的吸收，提高血清钙浓度，并减少锥体骨折的发病率，适用于绝经后及老年性骨质疏松症。雷洛昔芬通过与高亲和力雌激素受体结合，引起多种雌激素基因的表达，临床用于预防绝经后妇女骨质疏松。